羟基νOH的红外吸收特征峰的波数为
A. 3500cm⁻¹
B. 1740cm⁻¹
C. 1602cm⁻¹
D. 1230cm⁻¹
E. 885cm⁻¹

正确答案：A。3500cm⁻¹

解析：本题考查红外吸收光谱。羟基νO-H的红外特征吸收峰峰位（cm⁻¹）为3750～3000，3500cm⁻¹（A对）位于该区间内。1900～1650cm⁻¹（B错）为醛基、酮基、羧酸等的特征吸收峰。1670～1500cm⁻¹（C错）为C=C、C=N、N-H的特征吸收峰。1300～1000cm⁻¹（D错）为醚基、酯基、羧酸的特征吸收峰。1000～650cm⁻¹（E错）为不同取代形式双键、苯环的特征吸收峰。